下列指导低血容量性休克补液治疗最可靠的检测指标是
A. 血红蛋白
B. 颈外静脉充盈度
C. 中心静脉压
D. 肢端温度
E. 血细胞比容

正确答案：C。中心静脉压

解析：中心静脉压（C对）为休克特殊监测指标最常用的监测项目，中心静脉压代表了右心房或者胸腔段腔静脉内压力的变化，可反应全身血容量与右心功能之间的关系，且较动脉压变化要早、要敏感、要可靠，故临床上常用。血红蛋白（A错）和血细胞比容（E错）变化较晚，不敏感。颈外静脉充盈度（B错）较为粗糙，不太可靠。肢端温度（D错）是体表灌注情况的标志缺乏敏感性。